任何单位或个人开展医疗活动，必须依法取得
A. 《设置医疗机构批准书》
B. 《设置医疗机构备案回执》
C. 《医疗机构执业许可证》
D. 《医疗机构校验申请书》
E. 《医疗机构申请变更登记注册书》

正确答案：C。《医疗机构执业许可证》

解析：医疗机构的执业要求为：任何单位和个人，为取得《医疗机构执业许可证》，不得开展诊疗活动。医疗机构执业，必须遵守有关法律、法规和医疗技术规范。掌握“医疗机构概述及机构执业”知识点。